单室模型静脉注射给药的体内药量随时间变化关系式
A. C=k₀（1-e-kt）/Vk
B. logC＇=（-k/2.303）t＇+log（k₀/Vk）
C. logC＇=（-k/2.303）t＇+log［k₀（1-e-kt）/Vk］
D. logC=（-k/2.303）t+logC₀
E. logX=（-k/2.303）t+lqogX₀

正确答案：E。logX=（-k/2.303）t+lqogX₀

解析：本题考查药代动力学的相关知识。单室模型静脉注射给药的体内药量随时间变化关系式是lgX=（-k/2.303）t+lgX₀（E对）。C=k₀（1-e-kt）/Vk（A错）为单室模型静脉滴注给药，体内血药浓度与时间的关系式。BCE为干扰选项。